初产妇，因第二产程延长，行左侧会阴切开加低位产钳助产，娩出一4000g活婴。产后2小时伤口疼痛。肛门坠胀并有便意，大便常规检验正常。体检：贫血貌，BP90/60mmHg。左会阴稍肿，阴道出血不多。首先应作下列哪项处理
A. 宫缩剂
B. 阴道镜检查
C. 肛指检查
D. 抗炎
E. 止血剂

正确答案：C。肛指检查

解析：初产妇，因第二产程延长，行左侧会阴切开加低位产钳助产，娩出一4000g活婴（巨大胎儿，容易损伤产道）。产后2小时伤口疼痛。肛门坠胀并有便意（提示子宫直肠陷凹可能有积血），大便常规检验正常。体检：贫血貌，BP90/60mmHg。左会阴稍肿，阴道出血不多（隐匿性软产道损伤的体征），故患者考虑隐匿性软产道损伤，首先应作肛指检查（C对），其可以判定子宫直肠陷凹是否有积血，周围是否有血肿。宫缩剂（A错）一般用于因子宫收缩乏力引起的产后出血治疗。阴道镜检查（B错）一般用于宫颈癌诊断、子宫颈锥切术前确定切除范围、可疑外阴皮肤病变；可疑阴道鳞状上皮内病变、阴道恶性肿瘤、子宫颈、阴道及外阴病变治疗后复查和评估等。抗炎（D错）属于术后常规治疗，不作为首选治疗。止血剂（E错）一般见于有活动性出血患者的治疗。